支气管炎咳嗽的主要病机是
A. 肺失宣肃
B. 风热犯肺
C. 肺气郁闭
D. 外邪犯肺
E. 痰热蕴肺

正确答案：A。肺失宣肃

解析：慢性支气管炎的发生和发展，多因外邪侵袭、内脏亏损、导致肺失宣降（A对）。细菌性肺炎的多有暴感外邪，病邪犯肺而发（D错）。其中包括风热犯肺（B错）、痰热壅肺（E错）、热闭心包、阴竭阳脱。病毒性肺炎多有正气虚弱，卫外不固，复感风热疫毒之邪，导致痰热壅阻，肺气闭塞而发病（C错）。